孕妇初感胎动时间一般在
A. 12～16周
B. 16～18周
C. 18～20周
D. 20～22周
E. 22～26周

正确答案：C。18～20周